薏苡仁的原植物属于
A. 芸香科
B. 十字花科
C. 唇形科
D. 禾本科
E. 茜草科

正确答案：D。禾本科

解析：本题考查的是中药材的来源。薏苡仁的原植物属于禾本科（D对）。薏苡仁：【来源】为禾本科植物薏苡的干燥成熟种仁。来源于芸香科（A错）的中药有黄柏、关黄柏、白鲜皮、枳壳、吴茱萸等。来源于十字花科（B错）的中药有板蓝根、大青叶、葶苈子、芥子、莱菔子等。来源于唇形科（C错）的中药有丹参、黄芩、紫苏叶、广藿香、荆芥、益母草、薄荷、半枝莲、香薷等。来源于茜草科（E错）的中药有巴戟天、茜草、钩藤、栀子、白花蛇舌草等。